常见的烷化剂有
A. N-亚硝基化合物
B. 硫芥
C. 烷基硫酸酯
D. 以上都是

正确答案：D。以上都是

解析：本题考查常见的烷化剂。常见的烷化剂有N-亚硝基化合物、硫芥、烷基硫酸酯等（D对ABC错）。